哪项不是复面洞做成阶梯的作用
A. 分散（牙合）力
B. 保护牙髓
C. 少切割牙体组织
D. 抗力形
E. 便利形

正确答案：E。便利形

解析：本题考查窝洞的抗力形-阶梯结构。便利形是根管治疗开髓后形成的一个将根管口完全暴露直视下且便与器械进入的形状（E错，为本题的正确答案）。阶梯结构是窝洞的主要抗力形之一（D对）；可分散（牙合）力，使（牙合）力由（牙合）面髓壁和邻面龈壁分担（A对）；也可避免切削近髓处的牙体组织，减少了牙体组织的切割量（C对），避免露髓，保护牙髓组织（B对）。